在用双相滴定法测定苯甲酸钠的含量时，用乙醚萃取的物质是
A. 苯甲酸钠
B. 苯甲酸
C. 甲基橙
D. 盐酸
E. 氯化钠

正确答案：B。苯甲酸